孕12～14周起，子宫出现不规则的无痛性收缩称为
A. Hegar征
B. 蜕膜斑
C. Montgomery结节
D. Braxtonhicks收缩
E. 仰卧位低血压综合征

正确答案：D。Braxtonhicks收缩

解析：自妊娠12～14周起，子宫出现不规律无痛性收缩，特点为宫缩稀发、不规律和不对称，无疼痛感觉，称BraxtonHicks收缩，腹部检查时可以触知，孕妇有时也能感觉到。掌握“妊娠生理”知识点。